某男，70岁。心慌气短，动则加剧，夜间不能平卧，下肢浮肿，倦怠乏力，小便短少，口唇青紫，畏寒肢冷，咳吐稀白痰；舌淡苔白，脉虚弱。诊断为心悸，证属阳气虚乏、络瘀水停。宜选用的中成药是
A. 消疲灵颗粒
B. 芪苈强心胶囊
C. 参松养心胶囊
D. 安神补心丸
E. 朱砂安神片

正确答案：B。芪苈强心胶囊

解析：本题考查的是心悸的辨证论治。心慌气短，动则加剧，夜间不能平卧，下肢浮肿，倦怠乏力，小便短少，口唇青紫，畏寒肢冷，咳吐稀白痰；舌淡苔白，脉虚弱。诊断为心悸，证属阳气虚乏、络瘀水停。宜选用的中成药是芪苈强心胶囊（B对）。心悸是患者自觉心中悸动，惊惕不安，甚则不能自主的疾病，临床一般多呈反复发作性，每因情志波动或劳累而发作，且常伴胸闷、气短、失眠、健忘、眩晕、耳鸣等症状。（一）心脾两虚证：【中成药应用】常用中成药有人参归脾丸（大蜜丸）、复方扶芳藤合剂、益气养血口服液、消疲灵颗粒（A错）。（二）阴虚火旺证：【中成药应用】常用中成药有天王补心丸（水蜜丸）、朱砂安神片（E错）、宁神补心片、安神补心丸（D错）。（三）心阳不振证：【中成药应用】常用中成药有参仙升脉口服液、心宝丸、芪苈强心胶囊。（四）瘀阻心脉证：【中成药应用】常用中成药有血府逐瘀口服液、七叶神安片、稳心颗粒、参松养心胶囊（C错）。